收载于《中国药典》二部的品种是
A. 乙基纤维素
B. 交联聚维酮
C. 连花清瘟胶囊
D. 阿司匹林片
E. 冻干人用狂犬病疫苗

正确答案：D。阿司匹林片

解析：本题考查《中国药典》。收载于《中国药典》二部的品种是阿司匹林片（D对）。现行版《中国药典》 (2020 年版）是我国第十一版药典，系由一部、二部、三部、四部及其增补本组成。一部分三类收载中药，包括：药材和饮片；植物油脂和提取物；成方制剂和单味制剂。二部分两部分收载化学药品：第一部分收载化学药品、抗生素、生化药品及各类药物制剂（列于原料药之后）；第二部分收载放射性药物制剂。三部收载生物制品，包括：预防类、治疗类、体内诊断类和体外诊断类品种，同时还收载有生物制品通则、总论和通则。四部收载通则和药用辅料。乙基纤维素（A错）和交联聚维酮（B错）属于辅料，收载于《中国药典》四部。连花清瘟胶囊（C错）收载于《中国药典》一部。冻干人用狂犬病疫苗（E错）为生物制品，收载于《中国药典》三部。